细胞壁的主要成分为
A. 核质
B. 中介体
C. 肽聚糖
D. 核糖体
E. 异染颗粒

正确答案：C。肽聚糖

解析：细胞壁为包绕在细胞膜外的膜状结构，其组成较复杂，且因不同细菌而异，主要成分为肽聚糖等，其主要功能为保持菌体固有形态和维持菌体内外的渗透压。掌握“细菌的大小、形态和基本结构”知识点。